属于健康教育计划实施的过程评价指标是
A. 干预活动暴露率
B. 健康知识知晓率
C. 母乳哏养率
D. 高血压病控制率
E. 态度形成率

正确答案：A。干预活动暴露率